女性，37岁。诉牙齿自发性剧痛3天。有放散痛、夜间痛。口腔检查：患牙无明显龋损及其他牙体硬组织疾病，牙周袋深达根尖，温度刺激有激发痛，松动Ⅱ°。叩诊（+）。可能的诊断是
A. 急性牙周炎
B. 急性牙龈炎
C. 逆行性牙髓炎
D. 急性根尖周炎
E. 残髓炎

正确答案：C。逆行性牙髓炎

解析：本题考查逆行性牙髓炎。女性，37岁。诉牙齿自发性剧痛3天。有放散痛、夜间痛。口腔检查：患牙无明显龋损及其他牙体硬组织疾病，牙周袋深达根尖，温度刺激有激发痛，松动Ⅱ°。叩诊（+）。可能的诊断是逆行性牙髓炎（C对）。逆行性牙髓炎患牙可表现为自发痛、阵发痛、冷热刺激痛、放散痛、夜间痛等典型的急性牙髓炎症状，也可呈现为慢性牙髓炎的表现，患牙均有长时间的牙周炎病史，可诉有口臭、牙松动、咬合无力或咬合疼痛等不适症状。口腔检查可发现患牙有深达根尖区的牙周袋或较为严重的根分叉病变，牙有不同程度的松动；无引发牙髓炎的深龋或其他牙体硬组织疾病；患牙对叩诊的反应为轻度疼痛（+）～中度疼痛（++）。在本病例中患者有放散痛、夜间痛、冷热刺激痛的急性牙髓炎疼痛特点，也有深达根尖区的牙周袋，同时检查发现牙齿松动Ⅱ°，叩诊（+），患者的典型症状符合逆行性牙髓炎的特点。残髓炎（E错）的患牙常表现为自发性钝痛、放散性痛、温度刺激痛，无牙周炎表现。急性根尖周炎（D错）以患牙及其周围组织肿痛为主要表现，无典型的急性牙髓炎疼痛特点且多无牙周炎病史。牙周炎（A错）的患者多伴有附着丧失和牙槽骨的吸收，同时可有牙周袋形成，无放散痛、夜间痛。牙龈炎（B错）患者常在刷牙或咬硬物时牙龈出血，以牙龈组织的炎性肿胀为特点，没有放散痛、夜间痛的特点。